肝硬化最严重的并发症是
A. 肝性脑病
B. 原发性腹膜炎
C. 肝肾综合征
D. 电解质紊乱
E. 上消化道出血

正确答案：A。肝性脑病

解析：肝硬化的并发症有上消化道出血、胆石症、原发性腹膜炎（B错）、门静脉血栓形成或海绵样变、电解质紊乱（D错）、肝肾综合征（C错）、肝肺综合征、原发性肝癌、肝性脑病，其中肝性脑病（A对）为最严重的并发症，也是最常见的死亡原因，主要表现为性格、行为改变，意识障碍、昏迷等。上消化道出血（E错）为肝硬化最常见的并发症。